静脉叙述错误的是
A. 分为肺循环静脉和体循环静脉，
B. 体循环静脉分为浅、深静脉
C. 静脉均与同名动脉伴行
D. 静脉数量较动脉多
E. 颅盖骨内的静脉称为板障静脉

正确答案：C。静脉均与同名动脉伴行

解析：全身的静脉分为肺循环静脉和体循环静脉（A对）。体循环静脉分为浅、深静脉（B对）。浅静脉多不与动脉伴行（C错，为本题正确答案）。静脉的数量比动脉多（D对）。颅盖骨内的静脉称为板障静脉（E对）。